条件反射的特点是
A. 先天遗传而获得
B. 一种初级的神经活动
C. 种族共有的反射
D. 后天训练而建立
E. 反射弧固定不变

正确答案：D。后天训练而建立